以下内容不属于口腔诊疗清洁区域的是
A. 容器内的材料
B. 综合治疗台的支架桌
C. 牙医助手的工作台
D. 患者的病历
E. X线片

正确答案：B。综合治疗台的支架桌

解析：口腔诊疗清洁区域指的是治疗室内那些仅用干净的手或物品触碰的地方或设备的表面及材料等。如容器内的材料、X线片、患者的病历、牙医助手的工作台、材料瓶、医护人员的洗手池等。而综合治疗台的支架桌属于污染区域。掌握“患者、医务人员及环境的防护”知识点。